与铸造全冠相比，3/4冠的主要优点，除了
A. 美观
B. 龈缘刺激小
C. 就位容易
D. 强度好
E. 磨牙少

正确答案：D。强度好

解析：本题考查3/4冠的优点。与铸造全冠相比，3/4冠的主要优点，除了强度好（D错，为本题的正确答案）。与铸造全冠相比，3/4冠可以保留患牙的唇颊面，更美观（A对），磨牙少（E对）；与牙龈接触的龈边缘短，对牙龈刺激更小（B对）；牙体预备时更容易获得就位道，就位容易（C对）。正是因为牙体磨除量小，所以强度不如铸造全冠。